关于卵巢的形态，下列叙述正确的是
A. 呈前后略扁的卵圆形
B. 幼女卵巢表面凹凸不平
C. 被子宫阔韧带的前层所包绕
D. 分内、外两面，上、下两端，前、后两缘
E. 无

正确答案：D。分内、外两面，上、下两端，前、后两缘

解析：卵巢呈扁卵圆形（A错），分内、外侧面，前、后缘和上、下端（D对）;幼女的卵巢表面光滑（B错），性成熟后由于多次排卵，卵巢表面凹凸不平；卵巢被子宫阔韧带的后层（C错）所包绕。